治疗肛痈阴虚毒恋证，应首选
A. 透脓散
B. 仙方活命饮
C. 黄连解毒汤
D. 青蒿鳖甲汤合三妙丸
E. 萆薢渗湿汤

正确答案：D。青蒿鳖甲汤合三妙丸

解析：透脓散功能清热解毒透脓，为肛痈火毒炽盛证的选方（A错）。仙方活命饮功能清热解毒，消肿溃坚，活血止痛，为肛痈热毒蕴结证的选方（B错）。黄连解毒汤功能泻火解毒，主治三焦火毒证。（C错）。肛痈阴虚毒恋证治当养阴清热，祛湿解毒，方选青蒿鳖甲汤合三妙丸（D对）。萆薢胜湿汤可合仙方活命饮治疗肛痈热毒蕴结证伴有湿热之象者，功能清热利湿解毒（E错）。